氨基糖苷类引起的不良反应是
A. 伪膜性肠炎
B. 耳毒性
C. 牙釉质发育障碍
D. 肌腱炎
E. 再生障碍性贫血

正确答案：B。耳毒性

解析：本题考查氨基糖苷类药物的不良反应。氨基糖苷类的不良反应主要为耳毒性（B对）和肾毒性。